下列药物中具有广谱驱肠虫作用的有
A. 阿苯达唑
B. 吡喹酮
C. 盐酸左旋咪唑
D. 呋喃妥因
E. 嘧吡唑

正确答案：A、C。阿苯达唑；盐酸左旋咪唑

解析：本题考查抗肠蠕虫药。下列药物中具有广谱驱肠虫作用的有阿苯达唑（A对）、盐酸左旋咪唑（C对）。广谱驱肠虫药有甲苯咪唑、阿苯达唑、左旋咪唑。吡喹酮（B错）为抗血吸虫病药。呋喃妥因（D错）为合成抗菌药。嘧吡唑（E错）为抗炎镇痛药。